骨迷路
A. 为颞骨岩部和乳突部内的不规则腔隙
B. 位于鼓室内侧壁和内耳道之间
C. 包括蜗管、前庭和骨半规管
D. 前庭和蜗管属内耳的前部
E. 无

正确答案：B。位于鼓室内侧壁和内耳道之间

解析：骨迷路是颞骨岩部骨密质围成的不规则腔隙 （A错）, 分为耳蜗、前庭和骨半规管3 部分（C错），从前向后依次沿颇骨岩部长轴排列（B错，故D为本题正确答案）。